正确叙述副神经的是
A. 为副交感神经
B. 为交感神经
C. 支配环甲肌
D. 为运动性神经
E. 只支配胸锁乳突肌

正确答案：D。为运动性神经

解析：副神经为运动性神经（D对），含特殊内脏运动纤维（AB错），支配的肌肉包括咽喉肌、胸锁乳突肌、斜方肌（CE错）。